慢性阻塞性腮腺炎腮腺造影
A. 末梢导管呈点状、球状扩张，排空迟缓，主导管及腺内导管无明显异常
B. 主导管、叶间、小叶间导管部分狭窄、部分扩张，呈腊肠样改变
C. 末梢唾液腺导管扩张，排空功能减退
D. 圆形、卵圆形或梭形充盈缺损
E. 不宜做腮腺造影

正确答案：B。主导管、叶间、小叶间导管部分狭窄、部分扩张，呈腊肠样改变

解析：腮腺造影显示主导管、叶间、小叶间导管部分狭窄、部分扩张，呈腊肠样改变。部分伴有“点状扩张”，但均为先有主导管扩张，延及叶间、小叶间导管后，才出现“点状扩张”。掌握“慢性复发性腮腺炎”知识点。